以下说法错误的是
A. 突发公共卫生事件多为突然发生，且具有不确定性
B. 一般情况下，突发公共卫生事件的确切发生时间和地点具有不可预见性
C. 突发公共卫生事件不能预见
D. 人为引起的突发公共卫生事件的时间分布多无规律
E. 突发公共卫生事件的主要特征为：突发性、时间分布各异、地点分布各异、群体性、社会危害严重、应急处理的综合性

正确答案：C。突发公共卫生事件不能预见